疑核发出的纤维加入
A. 第7、8、9对脑神经
B. 第7、9、10对脑神经
C. 第7、9、12对脑神经
D. 第9、10、12对脑神经
E. 第9、10、11对脑神经

正确答案：E。第9、10、11对脑神经

解析：疑核属特殊内脏运动核，其上部发出的纤维进入舌咽神经（第9对脑神经），支配茎突咽肌；中部发出的纤维加入迷走神经（第10对脑神经），支配软腭和咽的骨骼肌， 喉的环甲肌和食管上部的骨骼肌。下部发出的纤维构成副神经脑根，进入副神经（第11对脑神经），出颅后又离开副神经而加入迷走神经，最后经迷走神经的喉返神经，支配除环甲肌以外的喉肌。因而疑核发出的纤维加入第9、10、11对脑神经（E对）。